平时呈静止状态，受到刺激可增殖为颌骨囊肿和牙源性肿瘤的是
A. 成骨细胞
B. 牙周膜干细胞
C. 上皮剩余细胞
D. 成牙骨质细胞
E. 成纤维细胞

正确答案：C。上皮剩余细胞

解析：本题考查上皮剩余的特点。上皮剩余（C对）平时呈静止状态，受到刺激可增殖为颌骨囊肿和牙源性肿瘤。上皮剩余是牙根发育期上皮根鞘残留下的上皮细胞，为牙周膜中邻近牙骨质的纤维间隙中的小上皮条索或上皮团，与牙根表面平行排列，也称Malassez上皮剩余。在光镜下细胞较小，立方或卵圆形，胞质少，嗜碱染色。电镜观察上皮剩余有基底膜将细胞与牙周膜的基质分开，相邻细胞有桥粒相连，胞质含有张力微丝和大量的核糖体。成纤维细胞（E错）是牙周膜中数量最多、功能最重要的细胞，具有独特且高效的合成与分解胞外基质中胶原蛋白的能力。牙周膜干细胞（B错）是牙周膜中的一种未分化的间充质干细胞，能够维持牙周组织的稳态，参与牙周组织的再生。成牙骨质细胞（D错）分布在邻近牙骨质的牙周膜中，细胞扁平，胞核圆或卵圆形，平铺在根面上，在牙骨质形成时近似立方状。成骨细胞（A错）在骨形成时，于邻近牙槽骨表面大量存在，呈立方状，胞核大，核仁明显，胞质嗜碱性，静止期的成骨细胞为梭形。